一般选20～30例健康成年志愿者，观察人体对于受试药的耐受程度和人体药动学特征，为制定后续临床试验的给药方案提供依据的新药研究阶段是
A. Ⅰ期临床试验
B. Ⅱ期临床试验
C. Ⅲ期临床试验
D. Ⅳ期临床试验
E. 0期临床试验

正确答案：A。Ⅰ期临床试验

解析：本题考查临床药理学研究。一般选20～30例健康成年志愿者，观察人体对于受试药的耐受程度和人体药动学特征，为制定后续临床试验的给药方案提供依据的新药研究阶段是Ⅰ期临床试验（A对）。①Ⅰ期临床试验：一般选20～30例健康成年志愿者，观察人体对于受试药的耐受程度和人体药动学特征，为制定临床研究的给药方案提供依据。②Ⅱ期临床试验（B错）：采用随机、双盲、对照试验，完成例数大于100例。③Ⅲ期临床试验（C错）：完成例数大于300例，为受试药的新药注册申请提供依据。④Ⅳ期临床试验（D错）：该期对最终确立新药的临床价值有重要意义。0期临床试验（E错）是指活性化合物在完成临床前试验后未正式进入临床试验之前，研制者使用微剂量在少量健康志愿者或者病人（通常为6～15人）进行的药物试验，收集必要的有关药物安全及药代动力学的试验数据，以评估研发药物是否具有进一步开发为新药或生物制剂的可能性，是从临床前试验过渡到Ⅰ期临床试验的中间环节。